细菌性肝脓肿的首选检査方法是
A. X线
B. CT
C. MRI
D. 放射性核素检查
E. B超

正确答案：E。B超

解析：B超对脓肿成像佳，且肝脏贴近胸壁，其它器官对肝脏成像影响较小。B超（E对）操作简单、价格便宜，阳性率高，可以准确测定脓肿部位、大小及距体表深度，是细菌性肝脓肿的首选检査方法。x线（A错）检查只能观察肝脏实质密度的变化，效果有限。CT（B错）、MRI（C错）、放射性核素检查（D错）操作繁琐、价格昂贵，不作为首选检查。